下列哪项属于副交感神经的作用
A. 瞳孔扩大
B. 糖原分解增加
C. 逼尿肌收缩
D. 骨骼肌血管舒张
E. 消化道括约肌收缩

正确答案：C。逼尿肌收缩